关于蒙脱石散的作用特点及临床使用的说法，错误的是
A. 不被胃肠道吸收，对中枢神经及心血管系统无不良影响
B. 直接服用或调成糊状、丸状服用
C. 对伴有感染的腹泻患者，应联合应用有效的抗菌药物治疗
D. 腹泻患者宜在两餐之间服用
E. 食管炎患者宜餐后服用

正确答案：B。直接服用或调成糊状、丸状服用

解析：本题考查蒙脱石散。蒙脱石散的服用方法如下：将本品倒入50ml温水中摇匀服用，直接服用或调成糊状、丸状服用均影响疗效（B错，为本题正确答案）。蒙脱石散不被胃肠道吸收，故不进入血液循环，对中枢神经及心血管等无不良影响（A对）。蒙脱石散无抗感染作用，感染性腹泻应联合抗菌药物（C对）。蒙脱石散用药时间：胃炎、结肠炎和肠易激综合征患者适宜在餐前服用，腹泻患者宜在两餐之间服用（D对）；胃食管反流、食管炎患者适宜餐后服用（E对）。